肾脏在胎儿期合成较多的激素是
A. 1，25-（OH）₂D₃
B. 前列腺素
C. 促红细胞生成素
D. 肾素
E. 利钠激素

正确答案：C。促红细胞生成素

解析：肾脏在胎儿期合成较多的激素是促红细胞生成素，受血氧分压的影响（C对），并且促红细胞生成素的浓度受学氧分压的影响。1，25－（OH）₂D₃是由肝和肾在婴儿期共同合成的，并不是在胎儿期合成的（A错）。前列腺素（B错）和肾素（D错）是在新生儿期（不是胎儿期）肾脏分泌的。利钠激素即抗利尿激素是由下丘脑分泌的，并不是由肾脏分泌的（E错）。